无19位甲基的甾体药物有
A. 黄体酮
B. 甲睾酮
C. 左炔诺孕酮
D. 炔雌醇
E. 炔诺酮

正确答案：C、D、E。左炔诺孕酮；炔雌醇；炔诺酮

解析：本题考查甾体激素类药物。无19位甲基的甾体药物有左炔诺孕酮（C对）、炔雌醇（D对）、炔诺酮（E对）。雌激素母核为雌甾烷，此类均无19位甲基，如炔雌醇。炔诺孕酮无19位甲基。雄性激素母核为雄甾烷，19位有甲基，如甲睾酮（B错）。黄体酮（A错）是孕激素类，19位有甲基。